患者胸胁疼痛，咳唾引痛，咳逆气喘，息促不能平卧，喜向右侧偏卧，右侧肋间胀满，舌苔白，脉沉弦，其治法是
A. 攻下逐饮
B. 和解宣利
C. 理气和络
D. 泻肺祛饮
E. 发表化饮

正确答案：D。泻肺祛饮

解析：攻下逐饮为痰饮饮留肠胃证的治法（A错）。和解宣利为悬饮邪犯胸肺证的治法（B错）。理气和络为悬饮络气不和证的治法（C错）。题中患者以胸胁疼痛，咳唾引痛，咳逆气喘，息促不能干卧为主症，故诊断为痰饮之悬饮，胸胁疼痛，右侧肋间胀满为肺气郁滞，气不布津，饮停有胸所致，饮停胸肋，脉络受阻，气机不利，咳嗽、转侧时牵引胸胁，故咳唾引痛，不能平卧，喜向右侧偏卧，水饮上迫于肺，肺气出入受阻，故息促，舌苔白，脉沉弦为水饮内结于里之象，故辨为饮停胸胁证，治宜泻肺祛饮（D对）。发表化饮为溢饮表寒里热证的治法（E错）。